关于锥体系的描述，错误的是
A. 起自中央后回和中央旁小叶
B. 分为皮质脊髓束和皮质核束
C. 脑神经运动核接受双侧皮质核束纤维
D. 损伤后深、浅反射消失
E. 下行纤维在延髓下部全部交叉

正确答案：A。起自中央后回和中央旁小叶

解析：锥体束起自中央前回和中央旁小叶前部的巨型锥体细胞 (Betz 细胞）和其他类型的锥体细胞（A错，为本题正确答案）。下行至脊髓的纤维束称皮质脊髓束 ; 止于脑干内一般躯体和特殊内脏运动核的纤维束称皮质核束（B对）。损伤后深、浅反射消失（D对），下行纤维在延髓下部全部交叉（E对）。